初孕妇，25岁。妊娠14周，少量阴道流血1天。妇科检查：阴道少量暗红色血液，宫口未开，子宫大小与孕周相符。该患者最可能的诊断是
A. 早期流产
B. 难免流产
C. 先兆流产
D. 稽留流产
E. 不全流产

正确答案：C。先兆流产

解析：初产妇，妊娠14周，少量阴道流血。妇科检查：阴道少量暗红色血液，宫口未开，子宫大小与孕周相符。最可能的诊断是先兆流产（C对）。难免流产（B错）在先兆流产基础上，阴道流血量较。妇科检查宫颈口已扩张，子宫大小与停经周数基本相符或略小。不全流产（E错）由难免流产继续发展，妇科检查见宫颈口已扩张，子宫小于停经周数。稽留流产（D错）为胚胎或胎儿已死亡，滞留宫腔内未能及时自然排出。妇科检查宫颈口未开，子宫较停经周数小（P71～P72）。早期流产（A错）发生在妊娠12周前。